患者，男，42岁。一周来入睡困难，甚至彻夜难眠，口苦心烦，舌质红，舌苔黄，脉弦数欲用朱砂镇心安神，药量应是
A. 0.01g
B. 0.5g
C. 3g
D. 5g
E. 10g

正确答案：B。0.5g

解析：朱砂的用法用量为0.1～0.5g（B对）。